一个2岁的女童，出生时身长为50cm，目前她的身长大约为
A. 89cm
B. 80cm
C. 84cm
D. 70cm
E. 74cm

正确答案：A。89cm

解析：本题考查女童期的体格生长发育特点。2岁后身长（高）的增长较稳定，每年平均5～7cm，2～10岁儿童的身高可按以下公式推算：身高（cm）=年龄（岁）×7（cm）+75（cm），因此该女童2岁的身长大约为2（岁）×7（cm）+75（cm）=89（cm）（A对BCDE错）。